能有效杀灭厌氧菌而对兼性厌氧菌无效的是
A. 四环素
B. 甲硝唑
C. 螺旋霉素
D. 罗红霉素
E. 环孢素

正确答案：B。甲硝唑

解析：本题考查甲硝唑。能有效杀灭厌氧菌而对兼性厌氧菌无效的是甲硝唑（B对）。四环素（A错）对革兰阳性菌的抑制作用强于阴性菌，但是对革兰阳性菌的作用不如青霉素类和头孢菌素类，对革兰阴性菌的作用不如氨基糖苷类及氯霉素类；极高浓度时具有杀菌作用；对伤寒杆菌、副伤寒杆菌、铜绿假单胞菌、结核分枝杆菌、真菌和病毒无效，由于耐药菌株日益增多和药物的不良反应，四环素一般不作首选药。螺旋霉素（C错）是一种很强的抑菌剂，仅在很高的浓度时才呈杀菌作用；具有强大的体内抗菌作用和抗菌后效应（PAE），能够增强吞噬细胞的吞噬作用，广泛分布于体内；可用于治疗由革兰阳性菌和某些革兰阴性菌引起的耳、鼻、喉和呼吸道感染，适用于治疗敏感菌所致的中耳炎、牙周炎、急性鼻窦炎等口腔及耳鼻咽喉科感染；也可用于治疗弓形虫病。罗红霉素（D错）是新一代大环内酯类抗生素，主要作用于革兰氏阳性菌、厌氧菌、衣原体和支原体等；其体外抗菌作用与红霉素相类似，体内抗菌作用比红霉素强1～4倍。环孢素（E错）为可抑制IL-2生成及其活性的免疫抑制剂，临床主要用于器官移植的防止排异反应、自身免疫性疾病尤其是其他药物无效的难治性自身免疫性疾病如类风湿关节炎、系统性红斑狼疮、银屑病、皮肌炎等。